毛细淋巴管
A. 遍布全身各处
B. 与毛细血管伴行,二者结构和通透性一致
C. 角膜与晶状体内缺如
D. 为淋巴管的起始端,开放于组织间隙
E. 管壁由内皮细胞、基膜和周细胞组成

正确答案：C。角膜与晶状体内缺如

解析：毛细淋巴管除脑、脊髓、骨髓、上皮、角膜、晶状体（C对）、牙釉质和软骨外,遍及全身各处（A错）。毛细淋巴管基膜不完整，仅由一层内皮细胞构成（E错），毛细淋巴管管壁甚至可以通过蛋白质细胞碎片、脂类等，通透性大于血管（B错）。毛细淋巴管以盲端起始与组织间隙，是淋巴管的起始端，但并不开放于组织间隙（D错）。